楔状缺损好发牙位是
A. 切牙
B. 尖牙
C. 前磨牙
D. 第一恒磨牙
E. 第二恒磨牙

正确答案：C。前磨牙

解析：本题考查楔状缺损。典型楔状缺损好发于中年以上患者的前磨牙（C对），其次是第一恒磨牙和尖牙，有时范围涉及第二恒磨牙以前的全部牙齿。